下列关于晶状体的描述,不正确的是
A. 位于虹膜与玻璃体之间
B. 呈双凸透镜状，且后面较前面隆凸
C. 为无色透明状，有良好的弹性
D. 为眼内折光系统的重要结构之一
E. 创伤后变混浊，称为青光眼

正确答案：E。创伤后变混浊，称为青光眼

解析：晶状体位于虹膜与玻璃体之间（A对），呈双凸透镜状，且后面较前面隆凸（B对），为无色透明状，有良好的弹性（C对），为眼内折光系统的重要结构之一（D对）。创伤后变浑浊，称为白内障，而非青光眼（E错，为本题正确答案）。青光眼由房水代谢紊乱或循环不畅造成。